对精索的描述中，正确的是
A. 为坚硬的结缔组织索
B. 自睾丸下端至腹股沟管皮下环
C. 为一柔软的肌性结构
D. 主要成分为输精管、睾丸动脉、蔓状静脉丛
E. 精索表面无被膜

正确答案：D。主要成分为输精管、睾丸动脉、蔓状静脉丛

解析：精索位于睾丸上端和腹股沟管腹环（B错）之间。精索内主要成分为输精管和睾丸动脉、蔓状静脉丛（D对）、输精管血管、神经、淋巴管和腹膜鞘突的残余（鞘韧带）等。精索表面包有三层被膜（E错），从内向外依次为精索内筋膜、提睾肌和精索外筋膜。